患者3天来尿道口红肿，尿急、尿频、尿痛，淋沥不止，尿液混浊如脂，尿道口溢脓，尿道粘膜水肿，淋巴结肿痛，舌红苔黄腻，脉滑数。西医诊断为急性淋病。治疗应首选方剂
A. 清营汤
B. 知柏地黄丸
C. 龙胆泻肝汤
D. 萆解渗湿汤
E. 四妙勇安汤

正确答案：A。清营汤

解析：根据患者尿液混浊如脂，尿道口红肿溢脓，诊断为热毒入络的湿热毒蕴证 ，治宜清热利湿，解毒化浊，故用清营汤（A对）；知柏地黄丸（B错）治疗阴虚毒恋的慢性淋病；龙胆泻肝汤（C错）治疗没有热毒入络的急性淋病；萆薢渗湿汤（D错）只能利湿通闭，不能清热；四妙勇安汤（E错）功效为清热解毒，活血止痛，主治 热毒炽盛之脱疽。